男，67岁。慢性咳嗽，咳少量白痰，活动后气短3年，近2月气短加重，痰量增多，为脓性痰。查体：口唇轻度紫绀，双下肺可闻及Velcro音，有杵状指。根据以上病史，症状和体征特点，对该患者最可能的诊断是
A. 淋巴样间质性肺炎
B. 特发性肺间质纤维化
C. 巨细胞型间质性肺炎
D. 慢阻肺
E. 支气管哮喘

正确答案：B。特发性肺间质纤维化

解析：患者为老年男性，慢性咳嗽，咳少量白痰，活动后气短3年，近2月加重，有脓性痰，双下肺可闻及Velcro音（为特发性肺间质纤维化特征性啰音），有杵状指（弥漫性肺间质纤维化患者体检约半数患者可见杵状指），根据其临床表现和体征，考虑诊断为特发性肺间质纤维化（B对）。淋巴细胞间质性肺炎（A错）在成人中罕见，但常见于儿童，咳嗽和气促是最常见的症状。其他症状包括消瘦，发热，关节疼痛和胸痛.胸部体检可发现捻发音，与该患者表现不符。巨细胞型间质性肺炎（C错）指大量肺泡腔内多核巨细胞沉积，并伴有肺间质炎症及纤维化为主要病理特征的肺弥漫性病变，该病在我国罕见，故不考虑为最可能的诊断。慢阻肺（D错）患者可有很长的咳嗽、咳痰病史，活动后气短，但无Velcro啰音。支气管哮喘（P29）（E错）主要表现为反复发作的喘息、气急、胸闷或咳嗽等症状，常在夜间及凌晨发作或加重，多数患者可自行缓解或经治疗后缓解，无杵状指和Velcro啰音。